危重病人，突然头额冷汗大出，四肢厥冷，属于
A. 亡阴
B. 亡阳
C. 阳虚
D. 阴虚
E. 以上均非

正确答案：B。亡阳

解析：亡阳证指体内阳气极度消耗而欲亡脱所表现的危重证候。头额冷汗大出，四肢厥冷，均因阳气极度衰微而欲脱，失却温煦、固摄、推动之能所致，故属于亡阳证（B对）。亡阴证以身灼烦渴、唇焦面赤、脉数疾、汗出如油等为辨证要点（A错）。阳虚证以畏冷肢凉、小便清长、面白、舌淡等为辨证要点（C错）。阴虚证以五心烦热、潮热盗汗、尿黄便结、颧红、舌红少苔、脉细数等为辨证要点（D错）。以上均非（E错）。